雷尼替丁抑制胃酸分泌的机制是
A. 阻断M₁受体
B. 阻断H₁受体
C. 阻断H₂受体
D. 促进PGE₂合成
E. 干扰胃壁细胞内质子泵的功能

正确答案：C。阻断H₂受体